粮谷类食品应强化的氨基酸是
A. 色氨酸
B. 组氨酸
C. 赖氨酸
D. 酪氨酸
E. 蛋氨酸

正确答案：C。赖氨酸